国际标准化组织推荐用下列哪一种指标作为噪声卫生评价的指标
A. C声级
B. A、B声级
C. B声级
D. A声级
E. D声级

正确答案：D。A声级

解析：本题考查声级的用途。A计权网络模拟人耳对40方纯音的响应，对低频段有较大幅度的衰减，对高频不衰减，A声级（D对）普遍被作为噪声的评价指标。C（A错）计权网络模拟人耳对100方纯音的响应特点，对所有频率的声音几乎都同等程度地通过，故可视作总声级。B（BC错）计权网络模拟人耳对70方纯音的响应曲线，对低频音有一定程度的衰减。D（E错）计权网络是为测量飞机噪声而设计的，可直接用于测量飞机噪声强度。